下列有皮肤损害的疾病中，禁用糖皮质激素的是
A. 牛皮癖
B. 接触性皮炎
C. 天疱疮
D. 湿疹
E. 水痘

正确答案：E。水痘

解析：糖皮质激素具有很强的抗炎作用，对细菌、病毒等病原微生物无影响，水痘（E错，为本题正确答案）是由水痘-带状孢疹病毒初次感染引起的急性传染病，一般不宜使用糖皮质激素，用后可能因降低机体的防御功能反使感染病灶扩散而恶化。糖皮质激素能够抑制感染性炎症和肺感染性炎症，抑制局部血管扩张，降低毛细血管通透性，改善红、肿、热、痛等症状，局部应用可用于治疗牛皮癣（A对），接触性皮炎（B对），湿疹（D对），肛门瘙痒等，但对天疱疮（C对）及剥脱性皮炎等严重的皮肤病仍需要全身给药。